吴茱萸汤的功用是
A. 温中补虚，理气健脾
B. 温中补虚，和里缓急
C. 温中补虚，降逆止痛
D. 温中补虚，降逆止呕
E. 温中补虚，散寒止痛

正确答案：D。温中补虚，降逆止呕

解析：该题考查吴茱萸汤的功用。吴茱萸汤功能，温中补虚，降逆止呕，吴茱萸汤四药配伍，温中与降逆并施，寓补益于温降之中，共奏温中补虚、降逆止呕之功。主治肝胃虚寒，浊阴上逆证（D对）。